治疗太阳头痛，循经选穴宜用
A. 百会、上星、行间
B. 上星、头维、合谷
C. 后溪、天柱、昆仑
D. 率谷、太阳、侠溪
E. 太阳、印堂、太冲

正确答案：C。后溪、天柱、昆仑

解析：后溪、天柱是太阳头痛的主穴，昆仑在足太阳膀胱经上，是太阳经上的腧穴，符合题干循经选穴的要求（C对）。百会、上星属督脉，行间属足厥阴肝经（A错）。上星属督脉，头维属足阳明胃经，合谷属手阳明大肠经（B错）。率谷属胆经，太阳属奇穴，侠溪属足少阳胆经（D错）。太阳、印堂属奇穴，太冲属足厥阴肝经（E错）。